大柴胡汤中的主治病证是
A. 身热下利，胸脘灼热，舌红苔黄，脉数
B. 往来寒热，胸胁苦满，苔黄，脉弦数有力
C. 憎寒壮热，胸膈痞闷，舌苔黄腻，脉数有力
D. 往来寒热，胸胁苦满，舌苔薄白，脉弦
E. 寒热如疟，胸胁胀痛，舌红苔白腻，脉数右滑左弦

正确答案：B。往来寒热，胸胁苦满，苔黄，脉弦数有力

解析：大柴胡汤以和解少阳的小柴胡汤与轻下阳明热结的小承气汤合方加减而成。功用和解少阳，内泻热结，主治少阳阳明合病。少阳病未解，故见往来寒热、胸胁苦满；邪入阳明，化热成实，气机被阻，腑气不通，故见心下痞硬，或心下急痛、大便不解、苔黄、脉数（B对）。